根据下列血气分析结果，判断酸碱失衡的类型：PH:7.34，PaCO₂：60mmHg，HCO₃⁻：31mmol/L
A. 代谢性酸中毒
B. 呼吸性酸中毒
C. 代谢性碱中毒
D. 呼吸性碱中毒
E. 酸碱平衡正常

正确答案：B。呼吸性酸中毒

解析：判断酸碱失衡的类型先判断PH后判断原发性紊乱：PH<7.35则为酸中毒，患者PaCO₂（正常范围为33~46 mmHg），HCO₃⁻（正常为22~27 mmoI/L）均上升，如果原发HCO₃⁻上升，PH值也应上升，所以原发性因素是PaCO₂上升，导致PH下降而发生呼吸性酸中毒（B对）。